预防乙型肝炎在人群中流行的最有效的措施是
A. 乙肝高效价免疫球蛋白接种
B. 乙型肝炎疫苗接种
C. 加强HBsAg携带者的管理
D. 切断经血传播途径
E. 阻断母婴传播

正确答案：B。乙型肝炎疫苗接种

解析：本题考查乙型肝炎的预防。人工免疫特别是主动免疫为预防肝炎的根本措施，因此，乙型肝炎疫苗免疫接种（B对ACDE错）是预防乙型肝炎在人群中流行的最有效的措施。